脑脊液
A. 由脑室的室管膜上皮产生
B. 位于硬脊膜与蛛网膜之间
C. 充满于蛛网膜下隙内
D. 经室间孔流入硬脑膜窦
E. 经蛛网膜粒渗入下矢状窦

正确答案：C。充满于蛛网膜下隙内

解析：脑脊液主要由脑室脉络丛产生（A错），少量由室管膜上皮和毛细血管产生。脑脊液(CSF) 是充满脑室系统、蛛网膜下隙（C对）（脊髓蛛网膜与软脊膜之间的间隙）（B错）和脊髓中央管内的无色透明液体。侧脑室脉络丛产生的脑脊液经室间孔流至第三脑室（D错）。经蛛网膜粒渗透到硬脑膜窦内（主要是上矢状窦）（E错），回流入血液中。